为研究某矿区附近人群多种慢性病的患病率及其分布特点，以了解开矿污染对附近村民健康影响，另选一个远离矿区无污染的村庄为对照，每个区各选1000名在当地居住10年以上、年龄在20岁以上的居民，进行体格检查并填写健康调查问卷。该种调查方法是
A. 群组病例对照研究
B. 现况研究
C. 社区试验
D. 队列研究
E. 生态学研究

正确答案：B。现况研究